下列既属六腑，又属奇恒之腑的是
A. 脑
B. 脉
C. 三焦
D. 胆
E. 骨

正确答案：D。胆

解析：本题考查的是脏腑分类。下列既属六腑，又属奇恒之腑的是胆（D对）。脏腑分类：根据脏腑的生理功能特点，分为三类：一是五脏，即心、肺、脾、肝、肾；二是六腑，即胆、胃、小肠、大肠、膀胱、三焦（C错）；三是奇恒之腑，即脑（A错）、髓、骨（E错）、脉（B错）、胆、女子胞。